某女，46岁。症见头痛昏重、胸膈痞闷、脘腹胀痛、呕吐泄泻，舌苔白腻。医师诊断为外感风寒、内伤湿滞证，处以藿香正气滴丸。处方组成：苍术160g、陈皮160g、姜厚朴160g、白芷240g、茯苓240g、大腹皮240g、生半夏160g、甘草浸膏20g、广藿香油1.6ml、紫苏叶油0.8ml。在《新型冠状病毒肺炎诊疗方案（试行第八版）》中，藿香正气滴丸被推荐用于医学观察期乏力伴胃肠不适的病例治疗。处方中厚朴用姜汁制的作用是
A. 增强宽中和胃作用
B. 增强祛瘀止痛作用
C. 增强止咳化痰作用
D. 增强健脾补血作用
E. 增强渗湿止泻作用

正确答案：A。增强宽中和胃作用

解析：本题考查的是厚朴的炮制作用。某女，46岁。症见头痛昏重、胸膈痞闷、脘腹胀痛、呕吐泄泻，舌苔白腻，医师诊断为外感风寒、内伤湿滞证，处以藿香正气滴丸。处方组成：苍术160g、陈皮160g、姜厚朴160g、白芷240g、茯苓240g、大腹皮240g、生半夏160g、甘草浸膏20g、广藿香油1.6ml、紫苏叶油0.8ml。在《新型冠状病毒肺炎诊疗方案（试行第八版）》中，藿香正气滴丸被推荐用于医学观察期乏力伴胃肠不适的病例治疗。处方中厚朴用姜汁制的作用是增强宽中和胃作用（A对）。厚朴：【炮制作用】厚朴味苦、辛，性温。归脾、胃、肺、大肠经。具有燥湿消痰、下气除满的功能。①生品辛味峻烈，对咽喉有刺激性，故一般内服都不生用。②姜厚朴可消除对咽喉的刺激性，并可增强宽中和胃的功效。多用于湿阻气滞，脘腹胀满或呕吐泻痢，积滞便秘，痰饮喘咳，梅核气。